通经下乳的药物是
A. 木通
B. 车前子
C. 益母草
D. 瞿麦
E. 地肤子

正确答案：A。木通

解析：木通为利尿通淋药物，苦、寒，入心、小肠、膀胱经，入血分，能通经下乳（A对）。用治血瘀经闭，可与红花、桃仁、丹参等同用；若用治乳汁短少或不通，可与王不留行、穿山甲等配伍。